具有“翘鼻头”“方胜纹”和“连珠斑”性状特征的药材是
A. 海马
B. 蛤蚧
C. 乌梢蛇
D. 蕲蛇
E. 金钱白花蛇

正确答案：D。蕲蛇

解析：本题考查的是蕲蛇药材的性状鉴别。具有“翘鼻头”“方胜纹”和“连珠斑”性状特征的药材是蕲蛇（D对）。蕲蛇：【性状鉴别】药材卷呈圆盘状。头在中间稍向上，呈三角形而扁平，吻端向上，习称“翘鼻头”。上腭有管状毒牙，中空尖锐。背部两侧各有黑褐色与浅棕色组成的“V”形斑纹，其“V”形的两上端在背中线上相接，习称“方胜纹”，有的左右不相接，呈交错排列。腹部灰白色，鳞片较大，有黑色类圆形的斑点，习称“连珠斑”；腹内壁黄白色，脊椎骨棘突较高，呈刀片状上突，前后椎体下突基本同形，多为弯刀状，向后倾斜，尖端明显超过椎体后隆面。尾部骤细，末端有三角形深灰色的角质鳞片1枚。气腥，味微咸。海马（A错）：【性状鉴别】药材线纹海马呈扁长形而弯曲。表面黄白色。头略似马头，有冠状突起，具管状长吻，口小，无牙，两眼深陷。躯干部七棱形；尾部四棱形，渐细卷曲，体上有瓦楞形节纹并具短棘。体轻，骨质，坚硬。气微腥，味微咸。蛤蚧（B错）：【性状鉴别】药材呈扁片状。头略呈扁三角形，两眼多凹陷成窟窿，口内角质细齿，生于颚的边缘，无异型大齿。吻部半圆形，吻鳞不切鼻孔，与鼻鳞相连。腹背部呈椭圆形，腹薄。背部灰黑色或银灰色，有黄白色或灰绿色斑点或橙红色斑点散在或密集成不显著的斑纹，脊椎骨和两侧肋骨突起。四足均有5趾；趾间仅具蹼迹，足趾底面具吸盘。尾细而坚实，微现骨节，与背部颜色相同，有6～7个银灰色环带，有的再生尾较原生尾短，且银灰色环带不明显。全身密被圆形或多角形微有光泽的细鳞。气腥，味微咸。乌梢蛇（C错）：【性状鉴别】药材呈圆盘状。表面黑褐色或绿黑色，密被菱形鳞片；背鳞行数成双，背中央2～4行鳞片强烈起棱，形成两条纵贯全体的黑线。头盘在中间，扁圆形，眼大而下凹陷，有光泽。脊部高耸成屋脊状。腹部剖开边缘向内卷曲，脊肌肉厚，黄白色或淡棕色，可见排列整齐的肋骨。尾部渐细而长，尾下鳞双行。剥皮者仅留头尾之皮，中段较光滑。气腥，味淡。金钱白花蛇（E错）：【性状鉴别】药材呈圆盘状。头盘在中间，尾细，常纳口中，口腔内上颌骨前端有毒沟牙。背部黑色或灰黑色，有白色环纹45～58个，背正中明显突起一条脊棱，脊鳞扩大呈六角形，背鳞细密。气微腥，味微咸。